血清钾的正常范围是
A. 3.50～5.50mmol/L
B. 135～145mmol/L
C. 96～108mmol/L
D. 12～15mmol/L
E. 3.61～6.11mmol/L

正确答案：A。3.50～5.50mmol/L

解析：血清钾的正常范围是3.50～5.50mmol/L。掌握“口外一般检查及辅助检查”知识点。